下列症状中哪项是浅龋的表现
A. 患者无症状
B. 遇甜酸等刺激痛
C. 遇冷热刺激痛
D. 进食物时疼痛
E. 以上各项均不是浅龋的症状

正确答案：A。患者无症状

解析：本题考查浅龋的临床表现。浅龋位于釉质内，病变未影响牙本质和牙髓，因此患者一般无症状（A对），受外界的物理和化学刺激如冷、热、酸、甜刺激时亦无明显反应。中龋或深龋时，可表现遇甜酸等刺激痛（B错）、遇冷热刺激痛（C错）。进食物时疼痛为深龋的临床表现（D错）。